片剂辅料中，既可用作填充剂，又可用作崩解剂的是
A. 磷酸氢钙
B. 山梨醇
C. 硬脂酸镁
D. 淀粉
E. 糊精

正确答案：D。淀粉